患者，男，60岁。咳嗽1个月，劳累后加重，咳吐粘痰，胸脘痞闷，胃纳减少，舌苔白腻，脉濡滑。治疗除取肺俞、太渊穴外，还应取
A. 风门、大椎、合谷
B. 章门、太白、丰隆
C. 脾俞、胃俞、列缺
D. 尺泽、列缺、外关
E. 脾俞、太冲、阴陵泉

正确答案：B。章门、太白、丰隆

解析：患者咳嗽，咳吐粘痰，胸脘痞闷，胃纳减少，呈现痰湿侵肺之象，舌脉亦为佐证，方义：原穴为本脏真气所输注，故取肺原太渊与脾原太白，配合肺俞、章门，健运脾土而利肺气，因脾为生痰之源，故脾肺同取，为标本合治之法，丰隆为足阳明经的络穴，取其推动中焦脾胃之气，使气行津布，痰湿得化（B对）。风门、大椎、合谷皆无化痰之功（A错）。脾俞、胃俞以补益脾胃为主，但化痰之力无丰隆强（C错）。列缺、外关可治外感咳嗽，尺泽可治伴咽喉肿痛者（D错）。太冲、阴陵泉可用于治疗肝火烁肺的咳嗽（E错）。